女，25岁。3个月来乏力伴四肢关节痛、脱发。化验：HB70g/L，N0.72，L0.25，M0.03，PLT135×10⁹/L，网织红细胞0.10，尿蛋白（++），血肌酐93umol/L。酸溶血试验阴性。骨髓检查显示增生明显活跃，粒红比例倒置。最可能的诊断是
A. 自身免疫性溶血性贫血
B. 骨髓增生异常综合征
C. 脾功能亢进
D. 肾性贫血
E. 阵发性睡眠性血红蛋白尿

正确答案：A。自身免疫性溶血性贫血

解析：患者青年女性，乏力伴四肢关节痛、脱发3个月，尿蛋白（++），血肌酐93μmol/L（正常值44～97μmol/L），提示患者有自身免疫性疾病SLE（自身免疫性溶血性贫血常见的继发性病因），血常规：HB70g/L（成年女性110～150g/L），提示贫血，N0.72（中性粒细胞比例正常0.5～0.75），L0.25（淋巴细胞比例0.2～0.4），M0.03（单核细胞比例正常0.03～0.08），白细胞比例均正常，PLT135×10⁹/L（正常值100～300×10⁹/L）正常，网织红细胞0.10（正常值0.005～0.015）明显增高，骨髓检查显示增生明显活跃，粒红比例倒置，提示骨髓红系代偿性增生（符合溶血性贫血的变化），酸溶血试验阴性，故考虑患者为自身免疫性疾病引起的自身免疫性溶血性贫血（A对）可能性大。骨髓增生异常综合征（P564）（B错）常有病态造血，外周血中有原始和幼稚细胞，全血细胞减少，以贫血、出血、感染为主要症状；脾亢（C错）时以脾肿大、功能亢进为特征，血细胞减少，早期以白细胞及血小板减少为主，重度脾亢时可出现三系明显减少；肾性贫血（P521）（D错）常见于慢性肾衰竭，肾功能明显减退，血肌酐异常升高；阵发性睡眠性血红蛋白尿（P560）（E错）酸溶血试验阳性。